关于大气污染物的有组织排放，不正确的是
A. 排出高度是指污染物通过烟囱等排放时烟囱的有效排出高度
B. 污染源下风侧的污染物最高浓度与烟波的有效排出高度的平方成反比
C. 有害气体的烟波着陆点是烟囱有效高度的10～20倍
D. 与污染源的距离是决定大气污染程度的最基本的因素
E. 近地面的大气中污染物的浓度以烟波着陆点处最大

正确答案：D。与污染源的距离是决定大气污染程度的最基本的因素

解析：本题考查污染源的排放情况。污染源的排放情况包括：1.排放量：污染物的排放量是决定大气污染程度的最基本的因素（D错，为本题正确答案）；2.与污染源的距离：有组织排放时，烟气自烟囱排出后，向下风侧逐渐扩散稀释，然后接触地面的点被称为烟波着陆点。一般认为有害气体的烟波着陆点是烟囱有效排出高度的10～20倍（C对），颗粒物的着陆点更接近烟囱。近地面大气中污染物的浓度以烟波着陆点最大（E对），下风侧大气污染物的浓度随着距离的增加而下降，在烟波着陆点和烟囱之间的区域常没有明显的污染。3.排出高度：排出高度指污染物通过烟囱等排放时烟囱的有效排出高度（A对），即烟囱本身的高度和烟气抬升高度之和，可以用烟波中心轴到地面的距离表示。一般认为，污染源下风侧的污染物最高浓度与烟波的有效排出高度的平方成反比（B对），即有效排出高度每增加一倍，烟波着陆点处断面污染物的浓度可降至原来的1/4。